LD₅₀是指
A. 绝对致死剂量
B. 最小致死剂量
C. 最大耐受剂量
D. 半数致死剂量

正确答案：D。半数致死剂量

解析：本题考查LD₅₀。LD₅₀即半数致死剂量（D对ABC错），指引起一组受试实验动物半数死亡的剂量。